不正确的是
A. 鼻腔被鼻中隔分为左、右两部分
B. 鼻腔可分为鼻前庭和固有鼻腔两部
C. 鼻中隔的前下部有一易出血区
D. 鼻粘膜均含嗅细胞
E. 无

正确答案：D。鼻粘膜均含嗅细胞

解析：鼻腔被鼻中隔分为左、右两部分（A对）。每侧鼻腔以鼻阈为界分为鼻前庭和固有鼻腔（B对）。鼻中隔的前下部有一易出血区（C对）。鼻黏膜只有嗅区富含嗅细胞（D错，为本题正确答案）。